引起牙髓活力电测验假阳性反应的原因正确的是
A. 探头接触了大面积的金属修复体
B. 受试牙未做到充分的隔湿或干燥
C. 牙髓有液化坏死
D. 患者过度紧张和焦虑
E. 以上均是

正确答案：E。以上均是

解析：本题考查牙髓电活力测验引起假阳性反应的原因。牙髓电活力测验引起假阳性反应的原因有：探头接触了大面积的金属修复体，通过金属，电流流向了牙周组织，使电活力测试出现假阳性（A对）；没有充分的隔湿或干燥，使电流通过水导电，出现假阳性（B对）；牙髓有液化坏死，电流通过液化坏死的牙髓导电，使金属修复体出现假阳性（C对）；患者过度紧张和焦虑，以致在探头刚接触牙面或被问及感受时示意有反应（D对）。（ABCD均对，故E为本题的正确答案）。